有关维生素C特性的描述，错误的是
A. 水溶液中易氧化
B. 遇热不稳定
C. 碱性溶液中极易破坏
D. 还原型与脱氢型都有生物活性
E. 可使羟脯氨酸、羟赖氨酸转化为脯氨酸、赖氨酸

正确答案：E。可使羟脯氨酸、羟赖氨酸转化为脯氨酸、赖氨酸